牙菌斑作为牙周病始动因素的依据，除了
A. 终止刷牙可引起实验性龈炎
B. 吸烟与牙周病有关
C. 洗必泰漱口液对牙龈炎治疗有效
D. 侵袭性牙周炎患者血清中的抗Aa抗体滴度增加
E. 根面平整对牙周炎治疗有效

正确答案：B。吸烟与牙周病有关

解析：吸烟与牙周病有关，但不是牙菌斑作为牙周病始动因素的依据。掌握“牙周炎病因学”知识点。